由免疫机制引起中性粒细胞减少的疾病
A. 假性粒细胞减少
B. Felty综合征
C. 低增生性白细胞
D. 巨幼细胞贫血
E. 骨髓增生异常综合征

正确答案：B。Felty综合征

解析：Felty综合征是指RA（类风湿性关节炎）患者伴有脾大、中性粒细胞减少，有的甚至有贫血和血小板减少。RA患者出现Felty综合征时并不都处于关节炎活动期，其中很多患者合并有下肢溃疡、色素沉着，皮下结节、关节畸形，以及发热、乏力、食欲减退和体重下降等全身表现。白细胞减少和粒细胞缺乏症免疫性因素见于各种自身免疫性疾病如Felty综合征（B对）（P571）；分布异常：假性粒细胞减少（A错），中性粒细胞转移至边缘池导致循环池的粒细胞相对减少，但粒细胞总数并不减少，见于异体蛋白反应、内毒素血症等。